牙周基础治疗后，牙龈肥大增生仍未消退，适用的手术治疗方法为
A. 翻瓣术
B. 牙龈切除术
C. 袋壁刮治术
D. 植骨术
E. 引导性牙周组织再生术

正确答案：B。牙龈切除术

解析：本题考查牙龈切除术的适应证。牙周基础治疗后，牙龈肥大增生仍未消退，适用的手术治疗方法为牙龈切除术（B对）。牙龈切除术是用手术方法切除增生肥大的牙龈组织或后牙某些部位的中等深度牙周袋，重建牙龈的生理外形及正常的龈沟；牙周基础治疗后，牙龈肥大增生仍未消退，说明简单的基础治疗不能治疗，所以需行牙龈切除术切除增生肥大的牙龈组织。翻瓣术（A错）是用手术方法切除部分牙周袋及袋内壁，并翻起牙龈的黏膜骨膜瓣，在直视下刮净龈下牙石和肉芽组织，从而到达消除牙周袋或使牙周袋变浅的目的。袋壁刮除术（C错）是用治疗牙周袋的方法，并不能去除肥大的牙龈。植骨术（D对）是用于某些牙槽骨病损修复的，不能治疗牙龈肥大。引导性牙周组织再生术（E错）是用手术的方法获得牙周组织的再生，不能治疗牙龈增生肥大。